异烟肼的抗菌作用特点是
A. 对静止期结核杆菌无抑菌作用
B. 对其他细菌也有效
C. 对细胞内的结核杆菌也有杀菌作用
D. 单用不易产生耐药性
E. 与其他同类药间有交叉耐药性

正确答案：C。对细胞内的结核杆菌也有杀菌作用